男孩，10岁。因高度水肿及大量蛋白尿，予泼尼松60mg/d治疗10周，病情未缓解来诊。查体：T36.5℃，P80次/分，R18次/分，颜面明显水肿，面色苍白，肺部未闻及啰音，心（-），腹部较膨隆，肝脾触及不清，四肢明显水肿，实验室检查：蛋白尿（+++），尿沉渣镜检RBC50/HP，肾功能正常。该患儿皮肤感染后出现发热，腹痛，四肢冰凉，尿少。查体，BP60/40mmHg，实验室检查：血钠121mmol/L，血钾5.8mmol/L，此时患儿出现的并发症是
A. 低血容量性休克
B. 急性胃炎
C. 肾小管功能障碍
D. 深静脉血栓形成
E. 急性肾衰竭

正确答案：E。急性肾衰竭

解析：该患儿出现低血压、低血钠及高钾血症，考虑并发急性肾衰竭（E对）。该患儿感染后引发急性肾小管坏死而引起的肾实质性肾衰竭，水钠潴留，不符合低血容量性休克（A错）的判断。急性胃炎（B错）常因钾丢失过多引起低钾血症，不符合题意。并发肾小管功能障碍（C错）时，可出现肾性糖尿或氨基酸尿。肾病综合症是并发肾静脉血栓形成（D错），表现为突发腰痛、出现血尿或血尿加重等。